内囊出血所致的对侧肢体运动障碍（偏瘫），主要是损伤了
A. 皮质脊髓束
B. 皮质红核束
C. 顶枕颞桥束
D. 皮质核束
E. 额桥束

正确答案：A。皮质脊髓束

解析：内囊聚集了大量的上下行传导束，特别是锥体束在此高度集中，锥体束包括皮质脊髓束（从大脑皮质至脊髓前角的纤维束）和皮质脑干束（从大脑皮质至脑干神经运动核的纤维束）。内囊出血时病灶对侧可出现偏瘫（锥体束损害）、偏身感觉障碍（丘脑皮质束）及偏盲（视辐射损害）。内囊出血所致的对侧肢体运动障碍（偏瘫），主要是损伤了皮质脊髓束（A对）。皮质核束（D错）即皮质脑干束，内囊出血致皮质脑干束损害出现病灶对侧中枢性面瘫。皮质红核束（B错）属于纹状体系统，顶枕颞桥束（C错）和额桥束（E错）属于前庭小脑系统，这两个系统共同组成锥体外系统，病损后主要出现肌张力变化和不自主运动两大类症状。